菌痢患者的粪便为
A. 水样便
B. 脓血便
C. 蛋花样便
D. 果酱样便
E. 柏油样便

正确答案：B。脓血便

解析：细菌性痢疾简称菌痢，是由志贺菌也称痢疾杆菌引起的肠道传染病。以腹痛、腹泻、排黏液脓血便（B对）、里急后重等为主要表现。霍乱肠毒素能促使肠黏膜杯状细胞分泌黏液增多，使水样便中含大量黏液。剧烈腹泻导致失水，胆汁分泌减少，患者的粪便可呈“米泔水”样（A错）。蛋花样便主要由病毒感染引起.主要由轮状病毒引起（C错）。急性阿米巴痢疾患者粪便检查呈暗红色果酱样便（D错）。柏油便常见于各种上消化道出血性疾病（E错）。